有关角膜的说法，错误的是
A. 约占外膜的前1/6，无色透明
B. 无血管分布
C. 神经末梢丰富
D. 营养可来自房水、泪液
E. 因缺乏血供，角膜移植不易成功

正确答案：E。因缺乏血供，角膜移植不易成功

解析：角膜约占外膜的前1/6，无色透明（A对），无血管分布（B对），但神经末梢丰富（C对），其营养可来自房水、泪液（D对，故E为本题正确答案）。